女，50岁。1小时前跌倒右手掌着地受伤，右肩疼痛，肿胀，功能障碍。查体：将患肘紧贴胸壁时，手掌不能搭到健侧肩部。此体征为
A. Dugas征
B. Mils征
C. Finkelstein征
D. Thomas征
E. Froment征

正确答案：A。Dugas征

解析：中年女性患者，跌倒右手掌着地受伤（受伤史），右肩疼痛，肿胀，功能障碍。查体：将患肘紧贴胸壁时，手掌不能搭到健侧肩部（Dugas征）（A对）。考虑诊断为肩关节脱位。Mills征(即伸肌腱牵拉试验）为伸肘，握拳，屈腕，然后前臂旋前，肘外侧出现疼痛为阳性，提示肱骨外上髁炎（B错）。Finkelstein试验即握拳尺偏试验，阳性为握拳尺偏腕关节时，挠骨茎突处出现疼痛，提示桡骨茎突狭窄性腱鞘（C错）。Thomas征用于检测髋关节是否屈曲畸形（D错）。Froment征阳性患者拇指、示指远侧指间关节不能屈曲，两者不能捏成圆形“O”状，提示尺神经损伤。